用于区别苯醌和蒽醌的反应是
A. Feigl反应
B. 无色亚甲蓝显色试验
C. Keller-Kiliani反应
D. Bornträger's反应
E. 与金属离子的络合反应

正确答案：B。无色亚甲蓝显色试验

解析：本题考查的是醌类化合物的显色反应。用于区别苯醌和蒽醌的反应是无色亚甲蓝显色试验（B对）。醌类化合物的显色反应：1.Feigl反应（A错）：醌类衍生物在碱性条件下加热与醛类、邻二硝基苯反应，生成紫色化合物。2.无色亚甲蓝显色试验：无色亚甲蓝乙醇溶液（1mg/ml）专用于检出苯醌及萘醌。样品在白色背景下呈现出蓝色斑点，可与蒽醌类区别。3.Bornträger's反应（D错）：在碱性溶液中，羟基醌类颜色改变并加深，多呈橙、红、紫红及蓝色。如羟基蒽醌类化合物遇碱显红至紫红色，称为Bornträger's反应。蒽酚、蒽酮、二蒽酮类化合物需氧化形成羟基蒽醌后才能显色，其机制是形成了共轭体系。4.Kesting-Craven反应：当苯醌及萘醌类化合物的醌环上有未被取代的位置时，在碱性条件下与含活性次甲基试剂，如乙酰乙酸酯、丙二酸酯反应，呈蓝绿色或蓝紫色。蔥醌类化合物因不含有未取代的醌环，故不发生该反应，可用于与苯醌及萘醌类化合物区别。5.与金属离子的反应（E错）：蒽醌类化合物如具有α-酚羟基或邻二酚羟基，则可与Pb²⁺、Mg²⁺等金属离子形成络合物。Keller-Kiliani（K-K）（C错）反应为α-去氧糖的颜色反应。Keller-Kiliani（K-K）反应：取样品1mg，用冰醋酸5ml溶解，加20%的三氯化铁水溶液1滴，混匀后倾斜试管，沿管壁缓慢加入浓硫酸5ml，观察界面和乙酸层的颜色变化。如有α-去氧糖，则乙酸层显蓝色。界面的显色，是由于浓硫酸对苷元所起的作用逐渐向下层扩散。其显色随苷元羟基、双键的位置和数目不同而异，可显红色、绿色、黄色等，但久置后因炭化作用，均转为暗色。此反应是α-去氧糖的特征反应，只对游离的α-去氧糖或α-去氧糖与苷元连接的苷显色，对α-去氧糖和葡萄糖或其他羟基糖连接的二糖、三糖及乙酰化的α-去氧糖，由于在此条件下不能水解出α-去氧糖而不显色。故此反应阳性可肯定α-去氧糖的存在，但对此反应不显色的有时未必具有完全的否定意义。